乳腺囊性增生症的临床表现最突出的特点是
A. 肿块质韧
B. 可有乳头溢液
C. 肿块呈颗粒状或结节状
D. 肿块大小不一
E. 疼痛与月经周期有关

正确答案：E。疼痛与月经周期有关